止于尺骨粗隆的肌肉是
A. 喙肱肌
B. 肱肌
C. 肱三头肌
D. 肱二头肌
E. 无

正确答案：B。肱肌

解析：喙肱肌（A错）止于肱骨中部内侧。肱肌（B对）止于尺骨粗隆。肱三头肌（C错）止于尺骨鹰嘴。肱二头肌（D错）止于桡骨粗隆。